女，30岁，阴道不规则流血20天，咳嗽5天。半年前行人工流产，吸出物见到绒毛组织，妇科检查：子宫如40天妊娠大小，质软，双侧附件区均可触及大小约5cm的囊性包块，胸部X线片示双侧中下野多发棉球状阴影。对明确诊断意义最大的检查是
A. 胸部CT
B. 血功能
C. 脑MRI
D. 血β-hCG
E. 盆腔超声

正确答案：D。血β-hCG

解析：女性患者，半年前行人工流产，吸出物见到绒毛组织（正常妊娠），现阴道不规则流血，双侧附件区均可触及大小约5cm的囊性包块（卵巢黄素化囊肿）。患者咳嗽，胸部X线片示双侧中下野多发棉球状阴影（提示肺转移）。据患者病史、临床表现及妇科检查，最可能的诊断为1.绒癌；2.转移性肺癌。对明确诊断意义最大的检查是血β-hCG（D对），影像学证据支持诊断（ACE错），但不是必需的。